关于恶性肿瘤，不正确的是
A. 肿瘤是一种与环境因素相关的疾病
B. 大气中B（a）P具有强致癌性
C. 肺癌男女患病率为1
D. 饮用水中N-亚硝基化合物和氯化消毒副产物超标与胃癌发生有关
E. 食管癌高发可与水受到亚硝胺等致癌物质污染有关

正确答案：C。肺癌男女患病率为1

解析：本题考查恶性肿瘤的相关内容。大气污染在城市和农村有着明显的差异，城市的肺癌发病率和死亡率均高于农村，城市越大，肺癌病死率越高。无论城市还是农村，男性发生率均高于女性。一般来说，肺癌发病年龄高峰在60～79岁之间；男女患病率为2.3∶1（C错，为本题正确答案）。